胃癌痰气交阻证的治法是
A. 疏肝和胃，降逆止痛
B. 活血化瘀，化痰软坚
C. 理气化痰，消食散结
D. 温中散寒，健脾调胃
E. 补气养血，健脾益肾

正确答案：C。理气化痰，消食散结

解析：胃癌痰气交阻证治法为理气化痰，消食散结（C对）。疏肝和胃，降逆止痛（A错）治疗肝胃不和证，方药选柴胡疏肝散合旋覆代赭汤加减。活血化瘀，化痰软坚（B错）适用于瘀毒内阻证，方药选膈下逐瘀汤加减。温中散寒，健脾调胃（D错）治疗脾胃虚寒证，方用理中汤合六君子汤加减。补气养血，健脾益肾（E错）治疗气血两虚证，方药选用八珍汤加减。